桩核冠修复的禁忌证中错误的是
A. 根尖发育未完成
B. 严重根尖吸收
C. 牙根极短牙
D. 牙槽骨吸收超过根长1/2
E. 冠折外伤牙

正确答案：E。冠折外伤牙

解析：核冠的禁忌证：年轻恒牙、根尖发育尚未完成、严重根尖吸收者，而根折缺损范围过大，根面位于龈下的话，无法通过正畸牵引等获得足够的生物学宽度为桩核冠的禁忌证。而冠折的牙齿只要缺损不达到龈下，就可以进行桩核冠的修复。掌握“牙体缺损修复体固位及适应、禁忌证”知识点。